可用于抗帕金森病的药是
A. 利多卡因
B. 阿司匹林
C. 阿托品
D. 异丙嗪
E. 金刚烷胺

正确答案：E。金刚烷胺

解析：本题考查治疗帕金森的药物。常用的治疗帕金森的药物有：①抗胆碱能药物（苯海索）。②促多巴胺释放剂（金刚烷胺）（E对）。③复方左旋多巴（左旋多巴/苄丝肼和左旋多巴/卡比多巴）。④多巴胺受体激动剂（普拉克索）。⑤单胺氧化酶B（MAO-B）抑制剂（司来吉兰）。利多卡因（A错）是Ib类抗心率失常药，是急性心肌梗死的室性早搏，室性心动过速及室性震颤的首选药。阿司匹林（B错）为非甾体抗炎药，主要用于解热镇痛。阿托品（C错）为M胆碱受体阻断剂，主要用于抢救感染中毒性休克、有机磷农药中毒的解救、缓解内脏绞痛、麻醉前给药等。异丙嗪（D错）为吩噻嗪类抗组胺药，具有明显的中枢安定作用。